人参根茎上的不定根习称
A. 芦头
B. 芦碗
C. 艼
D. 珍珠疙瘩
E. 铁线纹

正确答案：C。艼

解析：本题考查的是人参药材的性状鉴别。人参根茎上的不定根习称艼（C对）。人参：【性状鉴别】药材主根呈纺锤形或圆柱形。表面灰黄色，上部或全体有疏浅断续的粗横纹及明显纵皱纹，下部有支根2～3条，并着生多数细长的须根，须根上常有不明显的细小疣状突起。根茎（芦头（A错））多拘挛而弯曲，具不定根（艼）和稀疏的凹窝状茎痕（芦碗（B错））。质较硬，断面淡黄白色，显粉性，形成层环纹棕黄色，皮部有黄棕色的点状树脂道及放射状裂隙。香气特异，味微苦、甘。珍珠疙瘩（D错）与铁线纹（E错），2022年考试指南未明确说明。